可以作为一碳单位原料的氨基酸是
A. 酪氨酸
B. 赖氨酸
C. 谷氨酸
D. 组氨酸
E. 瓜氨酸

正确答案：D。组氨酸